乌梅的功效有
A. 敛肺
B. 涩肠
C. 生津
D. 安蛔
E. 补血

正确答案：A、B、C、D。敛肺；涩肠；生津；安蛔

解析：本题考查乌梅的功效。乌梅的功效有敛肺（A对）、涩肠（B对）、生津（C对）、安蛔（D对）。乌梅【功效】敛肺，涩肠，生津，安蛔，止血。桑椹【功效】滋阴补血（E错），生津，润肠。